男性，35岁。高热，皮肤瘙痒半月，右颈及锁骨上淋巴结肿大，无压痛，互相粘连，血红蛋白90g/L，白细胞10×10⁹/L，中性粒细胞66%，淋巴细胞24%，骨髓涂片找到里-斯细胞。如需明确诊断首先应作的检查是
A. 肝脾超声
B. 腹部或全身CT
C. 淋巴结活检
D. MRI
E. 中性粒细胞碱性磷酸酶测定

正确答案：C。淋巴结活检

解析：患者考虑为霍奇金淋巴瘤的可能性大，为明确诊断首先应进行淋巴结活检（C对）做组织病理学检查。肝脾超声（A错）只能查出单发或多发结节，不能明确病变性质；腹部或全身CT（B错）、MRI（D错）可发现淋巴结肿大，但不能确诊为淋巴瘤；中性粒细胞碱性磷酸酶测定（E错）主要用于骨肿瘤、恶性肿瘤骨转移的诊断。